股骨头骨软骨病的病理分期是
A. 缺血期、血供重建期、愈合期、畸形残存期
B. 缺血期、坏死早期、坏死中期、坏死晚期
C. 缺血期、变形期、愈合期
D. 缺血期、坏死期、愈合期
E. 缺血期、骨骺破坏期、愈合期

正确答案：A。缺血期、血供重建期、愈合期、畸形残存期

解析：股骨头骨软骨病的病理分期为缺血期、血供重建期、愈合期、畸形残存期（A对）。